急性胰腺炎属于
A. 感染性疾病
B. 遗传性疾病
C. 自身消化性疾病
D. 免疫性疾病
E. 结缔组织疾病

正确答案：C。自身消化性疾病

解析：急性胰腺炎是各种病因引起胰酶失活，导致胰腺的自身消化而发生的胰腺水肿、出血及坏死等炎性损伤，故急性胰腺炎属于自身消化性疾病（C对）。